奥美拉唑的临床应用适应证是
A. 消化性溃疡
B. 胃肠平滑肌痉挛
C. 慢性腹泻
D. 消化道功能紊乱
E. 萎缩性胃炎

正确答案：A。消化性溃疡

解析：奥美拉唑为质子泵抑制剂（PPI），使H⁺-K⁺-ATP酶失去活性，抑酸作用很强，是消化性溃疡（A对）的首选治疗药物。胃肠平滑肌痉挛（B错）的治疗应用M胆碱受体阻断药；慢性腹泻（C错）的病因包括肠道感染性疾病、肠道肿瘤、小肠吸收不良等，奥美拉唑对其无作用；消化道功能紊乱（P385）（D错）无器质性疾病，目前尚无特效药物，主要是经验性治疗；萎缩性胃炎（P356）（E错）首选对因治疗（抗幽门螺杆菌治疗），应用奥美拉唑只是对症治疗。